左旋多巴转化为多巴胺的作用机制是
A. 在外周脱羧变成多巴胺起作用
B. 促进脑内多巴胺能神经释放递质起作用
C. 进入脑后脱羧生成多巴胺起作用
D. 在脑内直接激动多巴胺受体
E. 在脑内抑制多巴胺再摄取

正确答案：C。进入脑后脱羧生成多巴胺起作用

解析：L-DOPA是多巴胺的前体，通过血脑屏障后，补充纹状体中多巴胺的不足而发挥治疗作用。口服L-DOPA后极大部分在肠黏膜、肝和其他外周组织被L-芳香族氨基酸脱羧酶（AADC）脱羧成为多巴胺。掌握“左旋多巴、卡比多巴、苯海索”知识点。